下述哪个结构与头面部痛觉传导有关
A. 面神经
B. 三叉神经脑桥核
C. 内侧丘系
D. 丘脑腹后内侧核
E. 内囊膝部

正确答案：D。丘脑腹后内侧核

解析：参与头面部的痛温觉和触压觉传导通路的第一级神经元为三叉神经节内假单极神经元。第2级神经元的胞体在三叉神经脊束核和三叉神经脑桥核，它们发出的纤维交叉到对侧。第3级神经元的胞体在背侧丘脑的腹后内侧核（D对）。